哪一个不属于突发公共卫生事件的流行特征
A. 突发性
B. 地点分布无差别
C. 群体性
D. 表现呈多样性
E. 预防的困难性

正确答案：B。地点分布无差别

解析：本题考查突发公共卫生事件的流行特征。突发公共卫生事件的特征包括：①突发性（A对）；②准备和预防的困难性（E对）；③表现呈多样性（D对）；④处置和结局的复杂性；⑤群体性（C对）；⑥后果的严重性。地点分布无差异（B错，为本题正确答案）不是突发公共卫生事件的流行特征。